能散风祛湿、排脓止痛的是
A. 白芷
B. 川芎
C. 两者都不是
D. 两者都是

正确答案：A。白芷

解析：本题考查的是白芷的功效。能散风祛湿、排脓止痛的是白芷（A对）。白芷：【功效】发散风寒，通窍止痛，燥湿止带，消肿排脓。川芎（B错）：【功效】活血行气，祛风止痛。